黄柏的原植物属于
A. 芸香科
B. 茄科
C. 樟科
D. 木兰科
E. 毛茛科

正确答案：A。芸香科

解析：本题考查的是黄柏的来源。黄柏的原植物属于芸香科（A对）。黄柏：【来源】为芸香科植物黄皮树的干燥树皮。来源于茄科（B错）的中药有地骨皮、洋金花、枸杞子、天仙子等。来源于樟科（C错）的中药有肉桂、天然冰片等。来源于木兰科（D错）的中药有厚朴、辛夷、五味子、南五味子等。来源于毛茛科（E错）的中药有威灵仙、川乌、附子、白芍、赤芍、升麻等。